流行性出血热少尿期最致死的水电解质酸碱紊乱是
A. 低钠血症、酸中毒
B. 高钾、低钠、酸中毒
C. 高镁血症、酸中毒
D. 低钾血症、碱中毒
E. 低钙血症、酸中毒

正确答案：B。高钾、低钠、酸中毒